关于细胞色素P450酶系，以下叙述中不正确的是
A. 是一组较为复杂的酶系
B. 主要的氧化酶是细胞色素P450
C. 主要由NADPH提供电子
D. 催化作用具有很高的专一性
E. 主要的氧化反应类型是羟化反应

正确答案：D。催化作用具有很高的专一性